提出五脏六腑皆令人咳病机的是
A. 《素问·生气通天论》
B. 《素问·至真要大论》
C. 《素问·咳论》
D. 《素问·痹论》
E. 《素问·阴阳应象大论》

正确答案：C。《素问·咳论》

解析：《素问·咳论》指出“肺之令人咳”，又提出“五脏六腑皆令人咳，非独肺也”。表明咳固然为肺病，而五脏六腑之病皆可令人咳（C对）。